多生牙较少见于
A. 乳牙列
B. 恒牙列
C. 混合牙列
D. 上颌前牙区
E. 双排牙列

正确答案：A。乳牙列

解析：多生牙在牙列中多生一个或几个牙，较少见于乳牙列，多见于混合牙列和恒牙列，其顺序是混合牙列＞恒牙列＞乳牙列。发生率在1%～3%之间。掌握“迟萌、多生牙和融合牙”知识点。